DNA链中减少了一对碱基可导致
A. 染色体畸变
B. 移码突变
C. 碱基置换
D. 大段损伤

正确答案：B。移码突变

解析：本题考查移码突变。移码突变（B对ACD错）指在DNA碱基序列中，插入或缺失一个或几个碱基（除了3或3的倍数），于是按三联密码连续阅读的规则，该部位以后的密码子组成全部改变，指导合成的多肽链也全部发生改变。